提示二度Ⅰ型房室传导阻滞的心电图表现是
A. 心室率不规整
B. 出现f波
C. PR间期逐渐延长，QRS波周期性脱落
D. 刺激迷走神经后心室率明显加快伴心律不齐
E. 出现F波

正确答案：C。PR间期逐渐延长，QRS波周期性脱落

解析：二度Ⅰ型房室传导阻滞这是最常见的二度房室阻滞类型，表现为：①PR间期进行性延长、直至一个P波受阻不能下传心室（C对）；②相邻RR间期进行性缩短，直至一个P波不能下传心室；③包含受阻P波在内的RR间期小于正常窦性PP间期的两倍。F波为心房扑动的心电图表现（E错）。f波为心房颤动的心电图表现（B错）。